根据《医疗用毒性药品管理办法》，关于医疗用毒性药品处方和调剂的做法，错误的是
A. 医疗单位供应和调配毒性药品，凭医生签名的正式处方
B. 每次处方剂量不得超过三日极量
C. 对处方未注明“生用”的毒性中药，应当付炮制品
D. 药店调配毒性药品，凭盖有医师所在的医疗单位公章的正式处方
E. 处方一次有效，取药后处方保存二年备查

正确答案：B。每次处方剂量不得超过三日极量

解析：本题考查医疗用毒性药品生产、经营要求。医疗用毒性药品每次处方剂量不得超过二日极量（B错，为本题正确答案）。零售药店供应和调配毒性药品，凭盖有医生所在的医疗单位公章的正式处方（D对）。每次处方剂量不得超过二日极量。医疗机构供应和调配毒性药品，须凭执业医师签名的正式处方（A对）。调配处方时，必须认真负责，计量准确，按医嘱注明要求，并由配方人员及具有药师以上技术职称的复核人员签名盖章后方可发出。对处方未注明“生用”的毒性中药，应当付炮制品（C对）。如发现处方有疑问时，须经原处方医生重新审定后再行调配。处方一次有效，取药后处方保存2年备查（E对）。